一般认为，致癌物的实际安全剂量所对应的可接受的危险度为
A. ≤1/100
B. ≤1/1000
C. ≤1/10000
D. ≤1/100000
E. ≤1/1000000

正确答案：E。≤1/1000000